发生于牙齿颊面或舌面，靠近釉牙骨质界处的龋损为
A. 釉质龋
B. 冠部龋
C. 牙髓炎
D. 牙颈部龋
E. 窝沟龋

正确答案：D。牙颈部龋

解析：平滑面龋损可进一步分为两个亚类：发生于近远中接触点处的损伤为邻面龋；发生于牙齿颊面或舌面，靠近釉牙骨质界处的龋损为牙颈部龋。掌握“龋病的临床表现与分类”知识点。